急性化脓性根尖周炎典型排脓途径中最常见的是哪种排脓方式
A. 穿通骨壁突破黏膜
B. 穿通骨壁突破皮肤
C. 通过根尖孔经根管排脓
D. 突破上颌窦壁排脓
E. 突破鼻底黏膜排脓

正确答案：A。穿通骨壁突破黏膜

解析：本题考查急性化脓性根尖周炎的排脓途径。急性化脓性根尖周炎典型的自然发展过程有四种排脓途径：（1）穿通骨壁突破黏膜（A对）：牙槽骨唇、颊侧的骨壁较薄，一般情况下上颌前牙、上颌后牙颊根以及下颌牙的根尖周脓肿多从牙槽骨的唇颊侧骨板穿出，形成骨膜下脓肿或黏膜下脓肿，最终在口腔前庭排脓。是急性化脓性根尖周炎典型排脓途径中最常见的。（2）穿破骨壁突破皮肤（B错）：有少数病例根尖部的脓液不在口腔内排脓，而是穿通骨壁绕过龈颊沟从皮肤排出，久之形成皮窦。（3）突破上颌窦壁排脓（D错）在临床上较为少见。（4）突破鼻底黏膜（E错）是一种较为罕见的排脓方式。通过根尖孔经根管排脓（C错）一般需要开通髓腔建立引流通道才能排脓，这种排脓方式不常见。